中医学认为，风湿性心脏瓣膜病多虚实夹杂，其本虚是指
A. 气虚、阳虚或阴虚
B. 气虚、血虚或阴虚
C. 气虚、血虚或阳虚
D. 水饮内停，瘀血内阻
E. 风寒湿邪，瘀血内阻

正确答案：A。气虚、阳虚或阴虚

解析：中医学认为，风湿性心脏瓣膜病属本虚标实，虚指气血阴阳亏虚。先天不足、年老体恤等正气虚弱，影响及心，致心气衰弱，损及心阳、心阴，气血衰败，发为此病（A对）先天禀赋不足，素体亏虚，或后天失养或年老体虚，以致正气不足，气血亏虚，腠理疏松，卫外不固，外邪易于侵袭，或感邪之后难以驱邪外出，导致外邪深入，累及于心；或因思虑日久劳伤心脾，气血化源不足，心神失养而发病。外邪入侵，内舍于心，邪耗正气，或素体正气虚弱，日久心气衰弱，气虚致气化机能障碍，使阴液生成减少，或素体阴虚，损及心阴，致气阴两虚。